患儿，男，15岁。咳嗽发热3天，双肺闻及散在的细湿啰音及广泛呼吸时哮鸣音，血常规：白细胞15×10⁹/L，中性粒细胞60%，胸片正位片：两下肺散在斑片状影，诊断最可能是
A. 合胞病毒肺炎
B. 支气管肺炎
C. 支原体肺炎
D. 腺病毒肺炎
E. 金黄色葡萄球菌肺炎

正确答案：B。支气管肺炎

解析：患儿，男，15岁。咳嗽发热3天，双肺闻及散在的细湿啰音及广泛呼吸时哮鸣音等表现提示可能为肺炎，而血常规：白细胞15×10⁹/L（白细胞高），中性粒细胞60%提示炎症较轻，可能为病毒性支气管肺炎，胸片正位片：两下肺散在斑片状影则高度提示该患儿为支气管肺炎（B对），一般儿童有发热、咳嗽、呼吸气促的症状，肺部听诊闻及中、细湿啰音（固定湿啰音）和（或）胸部影像学有肺炎的改变均可诊断为支气管肺炎。而合胞病毒肺炎（A错）多见于婴幼儿，尤其是1岁以内的儿童，临床上轻症患者发热、呼吸困难等症状不重；中、重症有较明显的呼吸困难、憋喘、口唇发绀、鼻翼煽动及三凹征。肺部听诊多有中、细湿啰音。X线表现为两肺可有小点片状、斑片状阴影，外周血白细胞总数大多正常，故该患儿不考虑此病。支原体肺炎（C错）的患儿咳嗽为本病的突出症状，肺部体征多不明显，体征与剧咳及发热等临床症状不一致为重要特点，X线检查为本病的重要诊断依据为肺部X线改变可为均匀一致的片状阴影似大叶性肺炎改变，故该患儿不考虑此病。腺病毒肺炎（D错）多见于6个月至2岁儿童，临床特点为起病急骤、高热持续时间长、中毒症状重、啰音出现较晚、X线改变较肺部体征出现早，可有大小不等的片状阴影或融合成大病灶，病灶吸收较慢，易合并心肌炎和多器官功能衰竭，故该患儿不考虑此病。金黄色葡萄球菌肺炎（E错）起病急、病情严重、进展快，全身中毒症状明显。发热多呈弛张热型，患儿面色苍白、烦躁不安、咳嗽等，肺部体征出现较早，两肺可有散在中、细湿啰音，发生脓胸、脓气胸等，X线检查可有小片状影，病变发展迅速，甚至数小时内可出现小脓肿、肺大疱或胸腔积液等，外周血白细胞多数明显升高，中性粒细胞增高伴核左移并有中毒颗粒，故该患儿不考虑此病。